处方中含有大量柏子仁、酸枣仁，粉碎宜采用
A. 加液研磨法
B. 水飞粉碎法
C. 串料粉碎法
D. 串油粉碎法
E. 超微粉碎法

正确答案：D。串油粉碎法

解析：本题考查中药粉碎的方法。处方中含有大量柏子仁、酸枣仁，粉碎宜采用串油粉碎法（D对）。串油粉碎：先将处方中其他中药粉碎成粗粉，再将含有大量油脂性成分的中药陆续掺人，逐步粉碎成所需粒度，或将油脂类中药研成糊状再与其他药物粗粉混合粉碎成所需粒度。需串油粉碎的中药主要是种子类药物，如桃仁、苦杏仁、苏子、酸枣仁、火麻仁、核桃仁、柏子仁等。湿法粉碎：1.加液研磨法（A错），系将药料先放入研钵中，加入少量液体后进行研磨，直至药料被研细为止。研樟脑、冰片、薄荷脑等药时，常加人少量乙醇；研麝香时，则加入极少量水。常采用“轻研冰片，重研麝香”的原则。2.水飞法（B错），水飞法系将非水溶性药料先打成碎块，置于研钵中，加入适量水，以杵棒用力研磨，直至药料被研细，如朱砂、炉甘石、珍珠、滑石粉等。当有部分研成的细粉混悬于水中时，及时将混悬液倾出，余下的稍粗大药料再加水研磨，再将细粉混悬液倾出，如此进行，直至全部药料被研成细粉为止。将混悬液合并，静置沉降，倾出上部清水，将底部细粉取出干燥，即得极细粉。很多矿物、贝壳类药物可用水飞法制得极细粉。但水溶性的矿物药如硼砂、芒硝等则不能采用水飞法。干法粉碎：1.单独粉碎。2.混合粉碎分为串料粉碎、串油粉碎、蒸罐粉碎。串料粉碎（C错）：先将处方中其他中药粉碎成粗粉，再将含有大量糖分、树脂、树胶、黏液质的中药陆续掺入，逐步粉碎成所需粒度。需要串料粉碎的中药有乳香、没药、黄精、玉竹、熟地、山萸肉、枸杞、麦冬、天冬等。超微粉碎（E错）又称超细粉碎，是指将粉粒物料磨碎到粒径为微米级以下的操作。